女，40岁。甲状腺右叶结节2年。结节大小1.5×1.0cm，穿刺活检结果为乳头状癌。骨扫描诊断右肱骨转移。此患者的临床分期是
A. Ⅲ期
B. Ⅰ期
C. Ⅳ期
D. Ⅱ期
E. 无法分期

正确答案：D。Ⅱ期

解析：甲状腺乳头状癌，40岁（55岁以下），骨转移（M1），因此属于Ⅱ期（D对）。